患者，男，35岁，近日出现足趾间皮肤瘙痒、水疱样皮疹，宜选用的药物是
A. 酮康唑乳膏
B. 甲硝唑片
C. 雌三醇乳膏
D. 硝酸咪康唑栓
E. 氯康唑胶囊

正确答案：A。酮康唑乳膏

解析：本题考查酮康唑乳膏。近日出现足趾间皮肤瘙痒、水泡样皮疹，宜选用的药物是酮康唑乳膏（A对）。酮康唑乳膏用于手癣、足癣、体癣、股癣、花斑癣及皮肤念珠菌病。甲硝唑栓（B错）适用于肠道及肠外阿米巴病、阴道滴虫病、贾第虫病、结肠小袋纤毛虫等寄生虫病的治疗。雌三醇乳膏（C错）用于雌激素缺乏引起的泌尿生殖道下部萎缩的治疗、绝经后妇女阴道术前和术后以及可疑的萎缩性宫颈涂片辅助诊断等。硝酸咪康唑栓（D错）局部治疗念珠菌性外阴阴道病和革兰阳性细菌引起的双重感染。氯康唑胶囊（E错）主要用于以下适应症中病情较重的患者：（1）念珠菌病：用于治疗口咽部和食管念珠菌感染；播散性念珠菌病，包括腹膜炎、肺炎、尿路感染等；念珠菌外阴阴道炎。尚可用于骨髓移植患者接受细胞毒类药物或放射治疗时，预防念珠菌感染的发生。（2）隐球菌病：用于治疗脑膜炎以外的新型隐球菌病或治疗隐球菌脑膜炎时，本品可作为两性霉素B联合氟胞嘧啶初治后的维持治疗药物。（3）球孢子菌病。（4）用于接受化疗、放疗和免疫抑制治疗患者预防念珠菌感染的治疗。（5）本品亦可替代伊曲康唑用于芽生菌病和组织胞浆菌病的治疗。